质量控制成分为总黄酮醇苷和萜类内酯的中药是
A. 槐花
B. 银杏叶
C. 黄芪
D. 黄芩
E. 葛根

正确答案：B。银杏叶

解析：本题考查的是银杏叶的质量控制成分。质量控制成分为总黄酮醇苷和萜类内酯的中药是银杏叶（B对）。银杏叶中的黄酮类化合物有黄酮、黄酮醇及其苷类、双黄酮和儿茶素类等。《中国药典》以总黄酮醇苷和萜类内酯为指标成分进行含量测定。要求总黄酮醇苷不少于0.4%，对照品采用槲皮素、山柰素和异鼠李素；要求萜类内酯不少于0.25%，对照品采用银杏内酯A、银杏内酯B、银杏内酯C和白果内酯。槐花（A错）中主要成分及其化学结构：槐米含有芦丁，槲皮素，皂苷等。其中，芦丁是有效成分。槐米中芦丁的含量高达23.5%，槐花开放后降至13.0%。《中国药典》以总黄酮和芦丁为指标成分对槐米或槐花进行含量测定。要求槐花总黄酮（以芦丁计）不少于8.0%，槐米总黄酮不少于20.0%，对照品采用芦丁；要求芦丁含量，槐花不得少于6.0%，槐米不得少于15.0%。黄芪（C错）的化学成分众多，主要含皂苷类、黄酮类、多糖类及氨基酸类等。黄芪皂苷具有多种生物活性，其中黄芪甲苷是黄芪中主要生理活性成分。《中国药典》以黄芪甲苷和毛蕊异黄酮葡萄糖苷为指标成分进行药材和饮片的含量测定，要求药材含黄芪甲苷不得少于0.080%，含黄芪甲苷不得少于0.060%；要求药材和饮片含毛蕊异黄酮葡萄糖苷不得少于0.020%。黄芩（D错）中主要成分及其化学结构：从黄芩中分离出来的黄酮类化合物有黄芩苷（含4.0%～5.2%）、黄芩素、汉黄芩苷、汉黄芩素等20种成分。其中黄芩苷是主要有效成分，具有抗菌、消炎作用。《中国药典》以黄芩苷为指标成分进行含量测定要求药材含量不得少于9.0%，饮片含量不得少于8.0%。葛根（E错）：含异黄酮类化合物，主要成分有大豆素、大豆苷、大豆素-7,4'-二葡萄糖苷及葛根素、葛根素-7-木糖苷。《中国药典》以葛根素为指标成分进行含量测定，要求含葛根素不得少于2.4%。